下列哪项不是深反射检查
A. 肱二头肌反射检查
B. 膝腱反射检查
C. 提睾反射检查
D. 跟腱反射检查
E. 桡骨骨膜反射检查

正确答案：C。提睾反射检查

解析：深反射是指刺激骨膜、肌腱经深部感受器完成的反射，包括肱二头肌反射检查（A错）、肱三头肌反射、跟腱反射检查（D错）、桡骨骨膜反射检查（E错）、膝腱反射检查（B错）及阵挛。而刺激皮肤或粘膜引起的反射为浅反射；提睾反射检查时，以刺激股内侧上方皮肤完成，故提睾反射检查（C对）为浅反射，不是深反射检查。